患者，男，38岁，左下第一前磨牙远中邻（牙合）面深龋，充填治疗2个月脱落，不可能的原因是
A. 充填物未垫底
B. 充填材料比例不当
C. 窝洞深度不够
D. 固位形不良
E. 继发龋发生

正确答案：A。充填物未垫底

解析：充填物是否垫底与脱落无关。深龋未垫底可能导致牙髓敏感。充填材料比例不当例如银汞合金当中的银汞比例不当会引起碰撞或者收缩过大，导致充填体脱落。窝洞深度不够，导致侧壁固位不足，充填体脱落。固位形不良可以直接导致充填体脱落。继发龋发生导致了窝洞边缘扩大，进而影响充填体的固位。掌握“龋病治疗出现问题及处理”知识点。